下列关于DNA复制特点的错误叙述是
A. 不需要RNA参与
B. 新生DNA链沿5’→3’方向合成
C. DNA链的合成是半不连续的
D. 复制是定点双向进行的
E. 需要DNA聚合酶

正确答案：A。不需要RNA参与